下列哪项不是替牙期的特征
A. 左右中切牙之间有一间隙
B. 侧切牙向远中倾斜
C. 前牙拥挤
D. 磨牙关系偏近中
E. 暂时性的深覆（牙合）

正确答案：D。磨牙关系偏近中

解析：在建（牙合）初期，上下颌第一恒磨牙的关系为远中（牙合）。乳磨牙脱落后，下颌第一恒磨牙向近中移动距离较上颌第一恒磨牙移动得多，成为中性（牙合）关系。掌握“（牙合）的生长发育”知识点。